神经递质、激素和细胞因子可通过下列哪条共同途径传递信息
A. 形成动作电位
B. 使离子通道开放
C. 与受体结合
D. 通过胞饮进入细胞
E. 使离子通道关闭

正确答案：C。与受体结合